患儿，女，9个月。右侧上唇Ⅰ度唇裂，其临床表现应该是
A. 裂隙只限于唇红部
B. 一侧完全裂，另一侧不完全裂
C. 整个上唇至鼻底完全裂开
D. 皮肤和黏膜完好，下方肌层未联合
E. 裂隙只限于白唇，红唇完好

正确答案：A。裂隙只限于唇红部

解析：Ⅰ度唇裂：仅限于红唇部分的裂开。掌握“唇裂”知识点。